有关TTS的表述，不正确的是
A. 可避免肝脏的首过效应
B. 可以减少给药次数
C. 可以维持恒定的血药浓度
D. 不存在皮肤的代谢与储库作用
E. 使用方便，可随时中断给药

正确答案：D。不存在皮肤的代谢与储库作用

解析：本题考查经皮给药制剂（TTS）的优点与缺点。经皮给药制剂（TTS）存在皮肤的代谢与储库作用（D错，为本题正确答案）。经皮给药制剂的缺点有：（1）由于皮肤的屏障作用，仅限于剂量小药理作用强的药物；（2）大面积给药，可能对皮肤产生刺激性和过敏性；（3）存在皮肤的代谢与储库作用。经皮给药制剂的优点包括：（1）避免口服给药的肝首过效应（A对）；（2）维持恒定的血药浓度（C对）；（3）延长作用时间，减少给药次数（B对）；（4）使用方便，患者可以自主用药，可随时中断给药（E对）。